顾步汤适用的脱疽证候是
A. 寒湿阻络
B. 血脉瘀阻
C. 湿热毒盛
D. 热毒伤阴
E. 气阴两虚

正确答案：D。热毒伤阴

解析：顾步汤功能清热解毒，养阴活血。脱疽寒湿阻络证应治以温阳散寒，活血通络（A错）。脱疽血脉瘀阻证应治以活血化瘀，通络止痛（B错）。脱疽湿热毒盛证应治以清热利湿，活血化瘀（C错）。脱疽热毒伤阴证应治以清热解毒，养阴活血（D对）。脱疽气阴两伤证应治以益气养阴（E错）。